男婴，早产，生后10天。母乳喂养，为预防佝偻病，家长来医院咨询。当小儿出现哪些表现时，可考虑为佝偻病初期
A. 多汗、夜惊
B. 方颅
C. 乒乓颅
D. 肋骨串珠
E. 精神萎靡

正确答案：A。多汗、夜惊

解析：本题考查维生素D缺乏性佝偻病的分期。佝偻病的初期多见6月龄以内，特别是3月龄以内小婴儿，主要为神经兴奋性增高的表现，如易激惹、烦闹、多汗（A对）刺激头皮致婴儿常摇头、擦枕而出现枕秃。临床上把维生素D缺乏性佝偻病分为4期，即初期、活动期、恢复期和后遗症期。佝偻病活动期由于缺乏维生素D没有及时的得到治疗有可能会伴随精神萎靡（E错），出现钙、磷代谢失常的典型骨骼改变：①颅骨：方颅（B错）、乒乓颅（C错）；②胸廓：肋骨串珠（D错）；③四肢：“手镯”“足镯”；④其他。